恶性多形性腺瘤光镜表现最常见的是
A. 腺上皮样组织
B. 肌上皮样组织
C. 黏液样组织
D. 低分化腺癌
E. 软骨样组织

正确答案：D。低分化腺癌

解析：恶性多形性腺瘤光镜表现为多形性腺瘤组织学结构中有数量不等的恶性成分，最常见的是低分化腺癌（唾液腺导管癌或非特异性腺癌）或未分化癌。掌握“基底细胞腺瘤及恶性多形性腺瘤”知识点。